x10cm囊性肿物。最有可能的诊断是
A. 腹膜后血肿
B. 脐疝
C. 肝左叶囊肿
D. 胰腺假性囊肿
E. 十二指肠憩室

正确答案：D。胰腺假性囊肿

解析：该患者8个月前有撞伤史（上腹部创伤均应考虑胰腺损伤的可能），6个月前觉上腹部逐渐隆起（胰腺假性囊肿易漏诊），伴上腹饱胀，近日来常恶心、呕吐。上腹部可触及直径约10cm 包块，影像学检查提示该患者上腹部10cmx10cm囊性肿物，综合患者的病史、临床变现和影像学检查，应诊断为胰腺假性囊肿（D对）。腹膜后血肿（A错）腹痛为最常见症状，血肿巨大或伴有渗入腹膜腔者可有腹肌紧张和反跳痛、肠鸣音减弱或消失。脐疝（B错）的主要临床表现是脐部可见球形或半球形可复性肿物。肝左叶囊肿（C错）可触及右上腹肿块和肝大。绝大部分的十二指肠憩室（E错）是由于先天性十二指肠局部肠壁基层缺陷所致，绝大多数无症状，少数表现为上腹部疼痛、恶心、嗳气、在饱食后加重。